具有营养全身和化生血液作用的是
A. 卫气
B. 营气
C. 元气
D. 宗气
E. 脏腑之气

正确答案：B。营气

解析：本题属于理解型题目，主要考查营气的生理功能及其他气的生理功能。故考生应当详细辨识并掌握各种气的功能。营气的生理功能主要是化生血液和营养全身（B对）。宗气聚于胸中，上走息道，推动肺的呼吸，故与语言、声音的功能密切相关；同时，宗气又贯注于心脉之中，促进心脏推动血液运行，故与心脏搏动也密切相关（D错）。元气的生理功能主要是推动和调节人体的生长发育和生殖机能；推动和调控各脏腑、经络、形体、官窍的生理活动（C错）。卫气的生理功能主要是防御外邪、温养全身和调控腠理（A错）。